呈椭圆形或长条形的薄片，切面灰棕色、橙黄色至灰黑色，角质样，内皮层环明显的饮片是
A. 大黄
B. 苍术
C. 郁金
D. 丹参
E. 黄连

正确答案：C。郁金

解析：本题考查的是郁金饮片的性状鉴别。呈椭圆形或长条形的薄片，切面灰棕色、橙黄色至灰黑色，角质样，内皮层环明显的饮片是郁金（C对）。郁金：【性状鉴别】饮片呈椭圆形或长条形的薄片。外表皮灰黄色、灰褐色至灰棕色，具不规则的纵皱纹。切面灰棕色、橙黄色至灰黑色，角质样，内皮层环明显。大黄（A错）：【性状鉴别】饮片呈类圆形或不规则形厚片或块，大小不等。外表皮黄棕色或棕褐色，有纵皱纹及疙瘩状隆起。切面黄棕色至淡红棕色，较平坦，根茎有明显散在或排列成环的星点，有空隙。气清香，味苦而微涩。苍术（B错）：【性状鉴别】饮片呈不规则类圆形或条形厚片，外表皮灰棕色至黄棕色，有皱纹，有时可见根痕。切面黄白色或灰白色，散有多数棕红色或橙黄色油点（油室），习称“朱砂点”，有的可析出白色细针状结晶。气香特异，味微甘、辛、苦。丹参（D错）：【性状鉴别】饮片为类圆形或椭圆形的厚片。外表皮棕红色或暗棕红色，粗糙，具纵皱纹。切面有裂隙或略平整而致密，有的呈角质样，皮部棕红色，木部灰黄色或紫褐色，有黄白色放射状纹理。气微，味微苦涩。黄连（E错）：【性状鉴别】饮片黄连片呈不规则的薄片，外表皮灰黄色或黄褐色，粗糙，有细小的须根。切面或碎断面鲜黄色或红黄色，具放射状纹理。气微，味极苦。